患者，女，51岁。月经不规律，精神萎靡，头晕耳鸣，腰痛如折，腹冷阴坠，形寒肢冷，淡苔白滑，脉沉细而迟。其治法是
A. 滋肾益阴
B. 滋阴潜阳
C. 益肾清肝
D. 补肾扶阳，益养冲任
E. 温肾壮阳，填精养血

正确答案：E。温肾壮阳，填精养血

解析：患者51岁，女子七七，天癸竭，地道不通，处于绝经前后，故月经不规律，肾虚封藏失职，冲任不固，肾阳虚衰，命门火衰，阳气不能外达，故精神萎靡，肾阳亏虚，不能蒸腾，故头晕耳鸣；肾阳虚衰，温煦失司，故腹冷阴坠，形寒肢冷，淡苔白滑，脉沉细而迟，治疗当温肾壮阳，填精养血（E对）。肾阴亏虚，精血不足，冲任失养，治当滋肾益阴（A错）。肾阴不足，阴虚则阳亢，治疗当滋阴潜阳（B错）。肝肾阴虚，阴血不足，肝火上炎，治疗当益肾清肝（C错）。肾阴不足，阴损及阳，阴阳两虚，冲任失调，治疗当补肾扶阳，益养冲任（D错）。